某糖尿病患者伴有浸润性肺结核，应用甲苯磺丁脲，利福平，链霉素，用抗结核药二月后，尿糖加重并出现肝功能不全原因是
A. 甲苯磺丁脲有肝毒性
B. 患者又染上了肝炎
C. 利福平诱导肝药酶且有肝损害
D. 链霉素的肾毒性
E. 以上都不是

正确答案：C。利福平诱导肝药酶且有肝损害

解析：肝脏毒性：长期大量使用利福平可出现黄疸、肝肿大、肝功能减退等症状，严重时可致死亡。掌握“异烟肼、利福平及乙胺丁醇”知识点。